对有害金属富集能力最强的蔬菜是
A. 叶菜类
B. 根茎
C. 豆类
D. 瓜类
E. 茄果类

正确答案：A。叶菜类

解析：本题考查对有害金属富集能力最强的蔬菜。不同的蔬菜对有害金属的富集能力差别较大，一般规律是叶菜＞根茎＞瓜类＞茄果类＞豆类（A对BCDE错）。